属于左向右分流型先天性心脏病的是
A. 肺动脉瓣狭窄
B. 二尖瓣关闭不全
C. 法洛四联症
D. 主动脉瓣狭窄
E. 室间隔缺损

正确答案：E。室间隔缺损

解析：先天性心脏病临床上根据心脏左、右两侧及大血管之间有无血液分流分为三大类：左向右分流型，右向左分流型和无分流型；其中左向右分流型（潜伏紫绀型）为在左、右心之间或主动脉与肺动脉之间具有异常通路，平时主动脉压力高于肺动脉压力，血液从左向右分流而不出现紫绀。当用力啼哭、屏气、肺炎或任何病理情况使肺动脉或右心室压力增高并超过左心压力时，则可使血液自右向左分流而出现暂时性紫绀。属于此型的有室间隔缺损（E对）、房间隔缺损和动脉导管未闭等。肺动脉瓣狭窄（A错）和主动脉瓣狭窄（D错）属于无分流型。二尖瓣关闭不全（B错）可见于风湿性或退行性心瓣膜病、二尖瓣脱垂、急性风湿热或运动、发热、贫血等症。法洛四联症（C错）属于右向左分流型。